某肺心病患者血气分析结果：pH7.26,PaCO₂11.4kPa(85.8mmHg).HCO₃⁻32mmo1/L,血Na⁺140mmol/L,CL⁻90mmol/l,其酸碱紊乱类型为
A. 呼吸性酸中毒
B. 代谢性碱中毒
C. AG增高性代谢性酸中毒
D. 呼吸性酸中毒合并代谢性碱中毒
E. 呼吸性酸中毒合并AG增高性代谢性酸中毒

正确答案：E。呼吸性酸中毒合并AG增高性代谢性酸中毒

解析：pH7.26<7.35可判定为酸中毒，引起酸中毒的原因可能有PaCO₂增高或HCO3-下降，由于患者PaCO₂（正常范围为33~46 mmHg）上升，故可判断为呼吸性酸中毒，根据单纯型酸碱平衡紊乱的代偿公式，PaCO₂每增高1 mmHg，HCO₃⁻增高0.35 mmol/L，该患者PaCO₂增高85.8-40=45.8 mmHg，HCO₃⁻应增高45.8×0.35=16.03±3 mmol/L，患者如是单纯型呼吸性酸中毒，HCO₃⁻应为24+16.03±3=37.03~40.03 mmol/L，患者HCO₃⁻为32mmo1/L，低于代偿值，表明患者是呼吸性酸中毒合并代谢性酸中毒，为混合型酸碱平衡紊乱。AG= Na+- (HCO₃⁻+Cl⁻）=18 mmo1/L>16 mmo1/L,表明患者是呼吸性酸中毒合并AG增高性代谢性酸中毒（E对）。